易发生冻结的药物是
A. 硫酸亚铁
B. 硝酸甘油
C. 麝香草酚
D. 半胱氨酸
E. 松节油搽剂

正确答案：E。松节油搽剂